药物经济学研究的主要范围是
A. 药物的治疗方案
B. 药物的生产成本
C. 药物的零售价格
D. 药物的治疗成本和效果
E. 药物的给药方式

正确答案：D。药物的治疗成本和效果

解析：本题考查的是药物经济学研究的目的。药物经济学研究的主要范围是药物的治疗成本和效果（D对）。药物经济学研究的目的：从全社会角度、运用药物经济学的基本理论和方法、利用药物流行病学的“人群”概念，通过对成本和相应效益两方面进行鉴别、测量和比较，决定出最佳的医疗服务方案，以最大限度地合理利用现有药物资源。